生姜泻心汤适于下列哪一项病证
A. 伤寒，胸中有热，胃中有邪气，腹中痛欲呕吐者
B. 心下痞硬，干噫食臭，胁下有水气
C. 胸中痞硬，气上冲咽喉不得息者
D. 伤寒发汗，若吐若下，解后，心下痞硬，噫气不除者
E. 胁下硬满，干呕不能食，往来寒热

正确答案：B。心下痞硬，干噫食臭，胁下有水气

解析：伤寒表证，通过发汗治疗，其表虽解，但“胃中不和”，究其原因，或因患者素体脾胃气弱，或是汗不如法损伤脾胃之气，以致邪气乘机内陷，寒热错杂于中，气机痞塞不通，脾胃升降失常，形成痞证。一般而言，心下痞应但满而不痛，按之柔软，此言“心下病硬”，是谓按之心下有紧张感，说明本证除无形之气据塞之外，还夹杂有水饮、食滞的有形之邪。然虽心下痞硬，却按之不痛。故仍属痞证而非结胸之证。“胁下有水气”，既言病机，提示本证有水饮内停中焦；又言症状，即胃脘两侧之胁下有水气相搏之辘辘作响。脾虚不运，胃气上逆，水食停滞于胃，故干噫食臭；水气流于胁下，或走于肠间，则肠鸣下利。治以生姜泻心汤和胃降逆，散水清痞（B对）。